27岁经产妇，妊娠39周，双胎妊娠。第一儿枕先露自然分娩，第二儿间隔8分钟臀助产娩出，历经10分钟娩出胎盘，随后阴道流血量达600ml，最可能的诊断是
A. 副胎盘残留
B. 胎盘残留
C. 子宫收缩乏力
D. 宫颈裂伤
E. 凝血功能障碍

正确答案：C。子宫收缩乏力

解析：青年经产妇，娩出第二胎儿10分钟后娩出胎盘，随之阴道流血（胎盘娩出后阴道流血较多，应考虑子宫收缩乏力），最可能诊断为子宫收缩乏力（C对），副胎盘残留（A错）和胎盘残留（B错）在胎儿娩出后10分钟内出血。宫颈裂伤（P212）（D错）在胎儿娩出后立即出血。凝血功能障碍（P212）（E错）表现为阴道持续流血且血液不凝。